社会医学的重要任务之一，就是研究和倡导适合于时代的
A. 方法论
B. 技术
C. 价值观
D. 理论
E. 医学模式

正确答案：E。医学模式